治疗瘾疹可采用拔罐法，常用的腧穴是
A. 血海
B. 膈腧
C. 神阙
D. 风门
E. 大椎

正确答案：C。神阙

解析：治疗瘾疹可在神阙穴拔罐（C对）。治疗瘾疹的主穴有膈腧、曲池、合谷、血海、委中。血海、膈腧治瘾疹采用毫针泻法（AB错）。风门、大椎不是治疗瘾疹的主穴（DE错）。